《中华人民共和国刑法》规定，生产、销售劣药，对人体健康造成严重危害的，处以
A. 三年以下有期徒刑，并处罚金
B. 三年以上十年以下有期徒刑，并处罚金
C. 十年以上有期徒刑
D. 十年以上有期徒刑或者无期徒刑，并处罚金或者没收财产
E. 十年以上有期徒刑、无期徒刑或者死刑

正确答案：B。三年以上十年以下有期徒刑，并处罚金